女，45岁。右上腹痛2天。2天前聚餐后突发右上腹疼痛，伴恶心，呕吐胃内容物1次。查体：T37℃，BP130/80mmHg，右上腹压痛（+），Murphy征阳性。血WBC14.1×10⁹/L，N0.82。进一步检查首选
A. 腹部B超
B. 磁共振胰胆管成像
C. 腹部CT
D. ERCP
E. 立位腹部X线平片

正确答案：A。腹部B超

解析：中年女性患者，饱餐后突发右上腹痛（急性胆囊炎典型症状），伴恶心呕吐，Murphy征阳性（急性胆囊炎典型体征），白细胞14.1×10⁹/L（正常值4～10×10⁹/L，升高提示感染），综上该患者应诊断为急性胆囊炎。超声检查是胆系疾病的首选检查方法，是检查胆囊壁病变最灵敏的检查方法，对急性胆囊炎的诊断准确率为85%～95%，进一步检查首选腹部B超（A对）。磁共振胰胆管成像（B错）、腹部CT（C错）可协助诊断，但其价格昂贵且操作复杂；ERCP（D错）即经内镜逆行性胰胆管造影术，为有创检查，易引起并发症，以上检查一般不作为首选检查项目。立位腹部X线平片（E错）对胆囊成像差，对急性胆囊炎的诊断价值不大。